在吸烟与肺癌关系的队列研究中，吸烟组肺癌的发病率为1.20‰，非吸烟组肺癌的发病率为0.4‰，经比较差异有统计学意义，研究结果说明
A. 吸烟者发生肺癌的危险不一定比非吸烟组高
B. 吸烟者发生肺癌的危险是非吸烟组的3倍
C. 吸烟人群中因为吸烟导致肺癌的比例是70%
D. 吸烟人群中因为吸烟导致肺癌的发生率为0.40‰
E. 普通人群中因为吸烟导致肺癌的比例是70%

正确答案：B。吸烟者发生肺癌的危险是非吸烟组的3倍

解析：本题考查相对危险度。相对危险度是指暴露组（1.20‰）发病或死亡的危险是非暴露组（0.4‰）的多少倍（1.20‰/0.4‰＝3），即两组危险度之比。该研究结果说明吸烟组发生肺癌的危险是非吸烟组的3倍（B对ACDE错）。